主要用于治疗高血压危象的药物是
A. 氯沙坦
B. 硝普钠
C. 硝苯地平
D. 依那普利
E. 氢氯噻嗪

正确答案：B。硝普钠

解析：本题考查高血压危象的治疗药。主要用于治疗高血压危象的药物是硝普钠（B对）。硝普钠主要用于高血压危象，伴有心力衰竭的高血压患者，也用于外科手术麻醉时控制性降压以及难治性慢性心功能不全。氯沙坦（A错）为血管紧张素Ⅱ受体拮抗剂，用于轻、中度高血压，适用于不同年龄的高血压患者，对伴有糖尿病、肾病和慢性心功能不全患者有良好疗效。硝苯地平（C错）为钙通道阻滞剂， 用于轻、中、重度高血压，尤其适用低肾素性高血压，可单用或与利尿药、β受体阻断药、血管紧张素Ⅰ转化酶抑制药合用。依那普利（D错）为血管紧张素转换酶抑制剂，是伴有左心室肥厚、左心功能障碍、急性心肌梗死、糖尿病肾病的高血压患者的首选药。氢氯噻嗪（E错）为噻嗪类利尿药，可单独应用治疗轻度高血压，也常与其他降压药合用以治疗中、重度高血压。